多根牙诸牙根之间的牙槽骨
A. 牙槽骨
B. 牙槽窝
C. 牙槽嵴
D. 牙槽间隔
E. 牙根间隔

正确答案：E。牙根间隔

解析：牙根间隔：多根牙各牙根之间的牙槽骨。掌握“上颌骨解剖特点”知识点。